某地发生的大规模不明发热流行中，当地的农民罹患率高，参加过支农劳动的国家职工发病者亦甚多，在寻找病因时，主要利用下列哪种逻辑思维方法
A. 求同法
B. 求异法
C. 共变法
D. 排除法
E. 以上都不是

正确答案：A。求同法